对受体有很高的亲和力和内在活性（α=1）的药物属于
A. 完全激动药
B. 部分激动药
C. 竞争性拮抗药
D. 非竞争性拮抗药
E. 反向激动药

正确答案：A。完全激动药

解析：本题考查作用于受体药物的分类。对受体有很高的亲和力和内在活性（α=1）的药物属于完全激动药（A对）。完全激动药也称激动剂，有很大的亲和力和内在活性（α=1），能与受体结合并产生最大效应。部分激动药（B错）具有较强亲和力，但内在活性低（α＜1）。竞争性拮抗药（C错）和非竞争性拮抗药（D错）均为拮抗药，与受体结合具有较强的亲和力，但缺乏内在活性（α=0）。反向激动药（E错）是指有些药物（如苯二氮䓬类）对失活状态的受体亲和力大于活化状态，药物与受体结合后引起与激动药相反的效应。